金瓷结合中最重要的结合力是
A. 机械嵌合
B. 范德华力
C. 倒凹固位
D. 化学结合
E. 压力结

正确答案：D。化学结合

解析：本题考查金-瓷结合的机制。烤瓷与金属基地的结合方式有四种，即化学结合、机械嵌合、物理性结合（范德华力）和界面压缩应力结合，其中烤瓷合金在预氧化处理过程中形成的氧化膜与瓷层结合产生化学结合（D对），占金­瓷结合力的52.5%，对金-瓷结合贡献最大；其次是机械嵌合（A错）和界面压缩应力结合（E错），金瓷结合面上经氧化铝喷砂处理后，会产生一定程度的粗糙面，这既增加瓷粉对烤瓷合金的润湿性，又增加了接触面积，也大大提高了机械结合力（占金瓷结合力的22%），瓷粉熔融后进入合金表面的凹陷内，还会产生压缩力（约占金瓷结合力的25.5%）；而物理性结合（范德华力）（B错），即金属与瓷之间熔融结合后后，产生紧密贴合的分子间的引力，对金瓷结合力贡献最小。倒凹固位（C错）不属于金­瓷结合力范围，是冠的固位方式。